可用作乳剂型基质防腐剂的是
A. 硬脂酸
B. 液体石蜡
C. 吐温80
D. 羟苯乙酯
E. 甘油

正确答案：D。羟苯乙酯